在上述著作中哪一本被美国的《生命伦理学百科全书》第一版的附录第四卷收录，被认为是世界上较早的医德法典
A. 《省心录·论医》
B. 《外科正宗·医家五戒十要》
C. 《医业伦理学》
D. 《医家十要》
E. 《万病回春》

正确答案：B。《外科正宗·医家五戒十要》

解析：明代陈实功在《外科正宗》中概括的“医家五戒十要”被美国1978年出版的《生命伦理学百科全书》列为世界古典医药道德文献之一（B对）。